下列有关牙签的使用方法及注意事项中，除外的是
A. 以45°角进入牙间隙，牙签尖端指向龈面
B. 牙签侧面紧贴邻面牙颈部
C. 清除邻面菌斑和嵌塞的食物后漱口
D. 注意防治刺伤龈沟底，破坏上皮附着
E. 勿将牙签压入健康的牙龈乳头区

正确答案：A。以45°角进入牙间隙，牙签尖端指向龈面

解析：牙签使用方法：将牙签以45°角进入牙间隙，牙签尖端指向（牙合）面，侧面紧贴邻面牙颈部，向（牙合）方剔起或作颊舌向穿刺动作，清除邻面菌斑和嵌塞的食物，并磨光牙面，然后漱口。注意事项：①勿将牙签压入健康的牙龈乳头区，以免形成人为的牙间隙；②使用牙签时动作要轻，以防损伤龈乳头或刺伤龈沟底，破坏上皮附着。掌握“菌斑控制及提高宿主抵抗力”知识点。